硝酸甘油的药理作用包括
A. 扩张外周血管，降低心脏负荷
B. 减慢心率，抑制心脏收缩力
C. 改善缺血区心肌血液供应
D. 促进糖代谢而改善心肌代谢
E. 升高血压，提高冠脉灌注压，增加缺血组织供氧

正确答案：A、C。扩张外周血管，降低心脏负荷；改善缺血区心肌血液供应

解析：本题考查硝酸甘油。硝酸甘油进入平滑肌细胞可分解为NO，增加cGMP的生成，使钙离子从细胞释放而松弛平滑肌，扩张血管，降低心脏负荷（A对），改善缺血区心肌血液供应（C对）。硝酸甘油扩张血管可引起血压降低（E错），反射性心率加快（B错）。